口腔内检查的内容包括
A. 余留牙及咬合关系情况
B. 缺牙部位的情况
C. 口腔黏膜及软组织情况
D. 颌骨及颌弓关系情况
E. 以上都对

正确答案：E。以上都对

解析：口腔内的检查：余留牙及咬合关系情况；缺牙部位的情况；口腔黏膜及软组织的情况；颌骨及颌弓关系情况；对原有修复体的检查。掌握“修复学临床检查”知识点。